关于肝素，哪项是错误
A. 肝素过量能引起骨质疏松
B. 肝素不能口服
C. 肝素是通过抗凝血酶Ⅲ起作用
D. 肝素用量越大，其抗凝活性t1/2越长
E. 肝素只在体外有抗凝血作用

正确答案：E。肝素只在体外有抗凝血作用

解析：肝素长期应用可致骨质疏松和自发性骨折（A对）（P264）。肝素口服不吸收，常需静脉给药（B对）。肝素的抗凝作用主要依赖于抗凝血酶Ⅲ（C对）（P263）。肝素抗凝活性t1/2因给药剂量而异，肝素用量越大，其抗凝活性t1/2越长（D对）。肝素在体内外肝素均有强大抗凝作用（E错，为本题正确答案）。